应通风干燥，防蛀储存的中药是
A. 生姜
B. 桔梗
C. 连翘
D. 龙眼
E. 川芎

正确答案：B。桔梗

解析：本题考查的是中药饮片的贮藏要求。应通风干燥，防蛀储存的中药是桔梗（B对）。含淀粉多的药材和饮片，如天麻、山药、粉葛根、葛根、桔梗等，应贮于通风、干燥处，以防虫蛀。含糖分及黏液质较多的饮片，如肉苁蓉、熟地黄、天冬、党参、龙眼肉（D错）等，应贮于通风干燥处。含挥发油多的药材和饮片，如薄荷、当归、川芎（E错）、荆芥等，贮藏时室温不可太高，否则容易走失香气或泛油，应置阴凉、干燥处贮存。